患者，男，50岁。患消渴病5年，症见腰膝酸软、头晕耳鸣骨蒸潮热、盗汗遗精、消渴。中医辨为肾阴虚证，处以六味地黄汤，药用熟地黄24g，酒萸肉12g、山药12g、泽泻9g、牡丹皮9g、茯苓9g。7剂，每日一剂，水煎服。患者服完7剂即来就诊，自诉消渴等症有所缓解，并云：因长期出差二不便服汤剂，希望服用组成与功效相同的成药。鉴此，医师根据病情，建议其服用以六味地黄丸方制成的成药，不适宜的剂型是
A. 浓缩丸
B. 颗粒剂
C. 胶囊
D. 小蜜丸
E. 软胶囊

正确答案：D。小蜜丸

解析：本题考查的是小蜜丸的成分。患消渴病，因长期出差二不便服汤剂，希望服用组成与功效相同的成药。鉴此，医师根据病情，建议其服用以六味地黄丸方制成的成药，不适宜的剂型是小蜜丸（D对）。蜜丸系指饮片细粉以炼蜜为黏合剂制成的丸剂。其中每丸重量在0.5g（含0.5g）以上的称大蜜丸，每丸重量在0.5g以下的称小蜜丸。患者患消渴病，即糖尿病，小蜜丸中含有糖，不适用于糖尿病患者。浓缩丸（A错）：系指饮片或部分饮片提取浓缩后，与适宜的辅料或其余饮片细粉，以水、炼蜜或炼蜜和水为黏合剂制成的丸剂。根据所用黏合剂的不同，分为浓缩水丸、浓缩蜜丸和浓缩水蜜丸。颗粒剂（B错）：系指原料药与适宜的辅料混合制成具有一定粒度的干燥颗粒状制剂。制备颗粒剂可根据需要加入适宜的辅料，如稀释剂、黏合剂、分散剂、着色剂以及矫味剂等。胶囊（C错）：系指原料药物或与适宜辅料充填于空心胶囊或密封于软质囊材中制成的固体制剂。软胶囊（E错）：系指将一定量的液体原料药物直接包封，或将固体原料药物溶解或分散在适宜的辅料中制备成溶液、混悬液、乳状液或半固体，密封于软质囊材中的胶囊剂。软胶囊又称胶丸，可用滴制法或压制法制备。